母亲通过胎盘把疾病传给胎儿，此种主要传播形式应为
A. 水平传播
B. 垂直传播
C. 连续性传播
D. 接触传播
E. 无传播

正确答案：B。垂直传播

解析：本题考查垂直传播的概念。垂直传播（B对ACDE错）是指在怀孕期间和分娩过程中，病原体通过母体直接传给子代。胎盘传播属于垂直传播的一种，即病原体通过胎盘屏障从受感染的孕妇体内经胎盘血液将病原体传给胎儿引起宫内感染。